疱疹性咽峡炎的病原体为
A. 流感病毒
B. 副流感病毒
C. 柯萨奇病毒
D. 单纯疱疹病毒
E. 支原体

正确答案：C。柯萨奇病毒